若牙体缺损累及牙本质或牙髓，可能出现下述临床问题，除外
A. 牙髓刺激症状
B. 牙髓变性或坏死
C. 根尖病变
D. 牙髓炎
E. 牙龈炎

正确答案：E。牙龈炎

解析：本题考查牙体缺损累及牙本质或牙髓的影响。牙龈炎（E错，为本题的正确答案）是当牙体缺损累及轴面，影响自洁时引发的。牙体缺损是指牙体硬组织发生的不同程度的外形和结构的破坏、缺损或发育畸形，造成牙体形态、咬合和邻接关系的异常，影响牙髓和牙周组织甚至全身的健康，对咀嚼、发音和美观等也将产生不同程度的影响。当牙体缺损累及牙本质，可出现牙髓刺激症状（A对），当牙体缺损累及深层牙本质甚至牙髓，可出现牙髓组织充血、牙髓变性或坏死（B对）、牙髓炎（D对）进而引起根尖病变（C对）。